对诊室的空气消毒常用的化学消毒剂为
A. 0.5%～1.0%的过氧乙酸
B. 0.2%漂白粉溶液
C. 2%～5%来苏溶液
D. 0.2%过氧乙酸
E. 500mg/L的氯消毒液

正确答案：A。0.5%～1.0%的过氧乙酸

解析：对诊室的空气消毒常用的化学消毒剂有：0.5%～1.0%的过氧乙酸水溶液熏蒸，或过氧化氢喷雾。在使用中注意所有消毒剂必须在有效期内，消毒时室内不能有人，甲醛因有致癌作用不能用于室内消毒。掌握“患者、医务人员及环境的防护”知识点。